对不伤害原则的解释，正确的是
A. 不伤害原则就是消除任何医疗伤害
B. 不伤害原则就是要求医生对患者丝毫不能伤害
C. 因绝大多数医疗行为都存在着不同程度的伤害，所以不伤害原则是做不到的
D. 不伤害原则要求对医学行为进行受益与伤害的权衡，把可控伤害控制在最低限度之内
E. 对肿瘤患者进行化疗意味着绝对伤害

正确答案：D。不伤害原则要求对医学行为进行受益与伤害的权衡，把可控伤害控制在最低限度之内

解析：不伤害原则的真正意义在于培养医务人员对病人高度负责、保护病人健康和生命的医学伦理理念和作风，正确对待医疗伤害现象，在实践中努力使病人免受不应有的医疗伤害，包括身体上、精神上的伤害和经济上的损失，即要求对医学行为进行受益与伤害的权衡，把可控伤害控制在最低限度之内（D对C错）。临床诊疗中的任何手段都可能存在利弊两重性，故对肿瘤患者进行化疗有利也有弊（E错），但有些伤害是难以避免的（AB错）。